患者身患外感实热病证，兼见喘咳，气不能接续，甚则心悸气短。其病机是
A. 实中夹虚
B. 虚中夹实
C. 真虚假实
D. 真实假虚
E. 因虚致实

正确答案：A。实中夹虚

解析：“患者身患外感实热病证”说明病理变化以实为主，“兼见喘咳，气不能接续，甚则心悸气短”说明患者除了实热病症外还有气虚的表现，所以可以得出实中夹虚的病机（A对，CD错）。因本证以外感实热为主，兼加气虚，并不是以气虚为主，所以可以排除虚中夹实（B错）。外感实热正并不是由机体虚弱导致的，所以不是因虚至实（E错）。